不含有B族维生素的辅酶是
A. 辅酶A
B. 磷酸吡哆醛
C. 细胞色素b
D. 四氢叶酸
E. 硫胺素焦磷酸

正确答案：C。细胞色素b

解析：本题考查不含有B族维生素的辅酶。细胞色素的辅基为血红素，属于铁卟啉化合物，由卟啉环与Fe²⁺螯合而成，不含有B族维生素（C对）。辅酶A（A错）所含维生素为泛酸（维生素B₅）。磷酸吡哆醛（B错）所含维生素为维生素B₆。四氢叶酸（D错）所含维生素为叶酸，属于B族维生素。硫胺素焦磷酸（E错）所含维生素为维生素B₁。